维护医患之间相互信任的关系，应除外
A. 主动赢得患者信任
B. 珍惜患者的信任
C. 对患者所提要求言听计从
D. 努力消除误解
E. 对患者出现的疑虑尽量澄清

正确答案：C。对患者所提要求言听计从